微囊的特点有
A. 减少药物的配伍变化
B. 使液态药物固态化
C. 使药物与囊材形成分子胶囊
D. 掩盖药物的不良臭味
E. 提高药物的稳定性

正确答案：A、B、D、E。减少药物的配伍变化；使液态药物固态化；掩盖药物的不良臭味；提高药物的稳定性

解析：本题考查微囊的特点。药物微囊化的特点：1. 提高药物的稳定性（E对）；2.掩盖药物的不良臭味（D对）；3.防止药物在胃内失活， 减少药物对胃的刺激性；4.控制药物的释放；5.使液态药物固态化（B对）；6.减少药物的配伍变化（A对）；7.使药物浓集于靶区。